青霉素可杀灭
A. 立克次体
B. 支原体
C. 螺旋体
D. 病毒
E. 大多数革兰阴性菌

正确答案：C。螺旋体

解析：本题考查青霉素。青霉素为青霉素类抗菌药物，是治疗钩端螺旋体（C对）病、梅毒及回归热的首选药。对大多数G⁻杆菌（E错）支原体（B错）作用较弱，对真菌、原虫、立克次体（A错）、病毒（D错）无作用。